女，40岁，体重50kg。胃大部切除术后2天，HCO₃⁻16mmol/L，输液时应首选
A. 5%葡萄糖氯化钠溶液
B. 含5%碳酸氢钠50ml的葡萄糖溶液
C. 含5%碳酸氢钠100ml的葡萄糖溶液
D. 含5%碳酸氢钠150ml的葡萄糖溶液
E. 含5%碳酸氢钠200ml的葡萄糖溶液

正确答案：A。5%葡萄糖氯化钠溶液

解析：患者胃大部切除术后出现血HCO₃⁻16mmol/L，低于正常血浆HCO₃⁻浓度22～27mmol/L，应诊断为代谢性酸中毒。根据代谢性酸中毒的治疗原则，较轻的代谢性酸中毒（血浆HCO₃⁻为16～18mmol/L）应先消除病因，再辅以补充5%葡萄糖氯化钠溶液（A对）、纠正缺水即可，不必应用碱性药物（BCDE错）。而对血浆HCO₃⁻低于10mmol/L重症酸中毒的病人，应立即输液和用碱性药物治疗。